风疹的皮疹特点是
A. 发热3～4天后出疹
B. 出疹1～2天后，开始发热
C. 淡红色斑丘疹，先见于面部，24小时内波及全身
D. 疹退后有色素沉着
E. 全身皮肤充血潮红

正确答案：C。淡红色斑丘疹，先见于面部，24小时内波及全身

解析：风疹的皮疹特点为发热1～2天后出疹，皮疹呈多形性，多为散在淡红色斑丘疹，也可呈大片皮肤发红或针尖状猩红热样皮疹，先见于面部，24小时内波及全身，常常是面部皮疹消退而下肢皮疹方现，一般历时3天，疹退后无脱屑或留有细小脱屑，但无色素沉着（C对）。发热3～4天后出疹（A错）见于麻疹和幼儿急疹。出疹1～2天后，开始发热（B错）不是风疹的皮疹特点。疹退后有色素沉着（D错）见于麻疹。全身皮肤充血潮红（E错）见于猩红热。